流行性斑疹伤寒的传播媒介是
A. 蜱
B. 人虱
C. 吸虫
D. 恙螨
E. 鼠蚤和鼠虱

正确答案：B。人虱

解析：流行性斑疹伤寒传播媒介是人虱。掌握“立克次氏体”知识点。